短时间内吸入大量的聚四氟乙烯热解气后，出现的症状有
A. 震颤
B. 腹痛、腹泻
C. 发热及感冒样症状
D. 神经系统症状
E. 贫血

正确答案：C。发热及感冒样症状